重构心肌的肌球蛋白重链主要表达
A. α-MHC
B. β-MHC
C. 两者均有
D. 两者均无
E. 无

正确答案：B。β-MHC

解析：当长期存在心肌损伤或负荷增加时，心脏可通过心室重塑进行代偿，心肌细胞重塑属于心室重塑的一种，包括心肌肥大和心肌细胞表型改变。慢性刺激可使心肌细胞中某些基因如β-MHC基因被激活，使重构心肌合成β-MHC增加（B对），发生表型改变。